能被碱水解的是
A. 胡萝卜苷
B. 水杨苷
C. 芦荟苷
D. 苦杏仁苷
E. 红景天苷

正确答案：B。水杨苷

解析：本题考查的是苷键的碱催化水解。能被碱水解的是水杨苷（B对）。苷键的碱催化水解：一般的苷键对稀碱应该相当稳定，不易被碱催化水解，但苷键具有酯的性质时，如苷元为酸、酚、有羰基共轭的烯醇类或成苷的羟基β-位有吸电子基取代者，遇碱就能水解。如水杨苷、4-羟基香豆素苷、藏红花苦苷等都可为碱所水解。对于苷键β-位有吸电子基团者，在碱液中易发生消除反应，而得到脱水苷元，例如藏红花苦苷通过碱水解生成双烯醛。苦杏仁苷（D错）为氰苷，可发生酶催化水解反应。芦荟苷（C错）为碳苷、红景天苷（E错）为醇苷，仅可发生酸催化水解反应。胡萝卜苷（A错），2022年考试指南未明确说明。